手术区皮肤消毒范围边缘至少距手术切口
A. 15cm
B. 13cm
C. 10cm
D. 20cm
E. 17cm

正确答案：A。15cm

解析：手术区皮肤消毒范围要包括手术切口周围15cm的区域（A对）。